6-巯基嘌呤、8-氮杂鸟嘌呤具有抗肿瘤作用的可能机制是
A. 抑制嘌呤的补救合成
B. 抑制RNA聚合酶
C. 抑制DNA聚合酶
D. 碱基错配
E. 抑制蛋白质合成酶

正确答案：A。抑制嘌呤的补救合成